青霉素作用的细菌靶位是
A. 细胞质的质粒
B. 细胞质的核糖体
C. 细胞壁的聚糖骨架
D. 细胞壁的磷壁酸
E. 细胞壁的五肽交联桥

正确答案：E。细胞壁的五肽交联桥

解析：青霉素类属于β-内酰胺类抗生素，能抑制细胞壁肽聚糖上四肽侧链与五肽桥的交联（E对），从而抑制细菌细胞壁的合成而发挥抗菌作用。大环内酯类抗生素作用于细胞质核糖体（B错），从而抑制细菌蛋白质的合成。（八版微生物学P15）溶菌酶的作用机理是裂解肽聚糖中N-乙酰葡萄糖胺和N-乙酰胞壁酸之间的β-1，4糖苷键，破坏聚糖骨架（C错）从而引起细菌裂解。暂无抗生素的作用靶位点是细胞质的质粒及细胞壁上的磷壁酸（AD错）。